一患者不慎摔伤面部，临床检查及X线片提示下颌骨体部骨折，患者最具特征性的体征是
A. 上唇及牙龈的肿胀和撕裂
B. 摇动损伤区某一牙时，余牙随之移动
C. 上前牙松动
D. 咬合错乱
E. 下唇麻木

正确答案：D。咬合错乱

解析：本题考查下颌骨骨折的临床表现。一患者不慎摔伤面部，临床检查及X线片提示下颌骨体部骨折，患者最具特征性的体征是咬合错乱（D对）。下颌骨骨折表现为骨折段移位、咬合错乱、骨折段异常动度、下唇麻木、张口受限、牙龈撕裂，其中最具特征的临床表现为咬合错乱。